下列致病因素不引起人体感染的是
A. 病毒
B. 真菌
C. 原虫
D. 毒素
E. 朊毒体

正确答案：D。毒素

解析：感染是病原体导致的，病原体包括微生物和寄生虫，以及近年来发现的感染性变异蛋白质朊粒（朊毒体）（E对），病毒（A对）属于非细胞型微生物，真菌（B对）属于真核细胞型微生物，原虫（C对）属于寄生虫，以上都是可以引起人体感染的致病因素，毒素（D错，为本题正确答案）不是病原体，不会引起人体感染。